下列哪项不是影响青少年近视的主要原因
A. 睡眠时间短
B. 视近工作时间长
C. 躺着看书
D. 未定期检查视力
E. 近视家族史

正确答案：D。未定期检查视力